不属于克山病的流行特征的是
A. 机关团体多发
B. 农业人口多发
C. 年度多发
D. 家庭中多发
E. 季节多发

正确答案：A。机关团体多发

解析：本题考查克山病的流行特征。克山病是一种以心肌变性坏死为主要病理改变的生物地球化学性疾病。其流行特征有：1.克山病年度发病率波动较大，有高发年、低发年、平年之区别（C对）；2.有明显的季节多发现象，包括“冬季型”、“夏季型”和“春季型”克山病（E对）；3.克山病以农业人口发病为主（B对）；4.克山病具有一定的家族聚集性，在家庭中多发（D对）。机关团体多发（A错，为本题正确答案）不属于克山病的流行特征。